女，25岁。停经7周，1h前突感下腹部疼痛，伴肛门坠胀感。査体：皮肤苍白，下腹压痛反跳痛腹肌紧张，阴道后穹窿饱满，有压痛。该患者最有可能诊断是
A. 输卵管妊娠
B. 肠结核
C. 急性输卵管炎
D. 急性肠炎
E. 胃溃疡穿孔

正确答案：A。输卵管妊娠

解析：育龄期女性，停经7周（输卵管妊娠常有6～8周的停经史），突发下腹痛，伴肛门坠胀感（典型症状为停经后腹痛与阴道流血，输卵管妊娠破裂时突感一侧下腹部撕裂样疼痛），皮肤苍白（输卵管妊娠破裂时疼痛和出血引起），下腹部压痛、反跳痛、腹肌紧张（腹部检查：下腹有明显压痛及反跳痛，尤以患侧为著，但腹肌紧张轻微），阴道后穹隆饱满，有压痛（输卵管妊娠流产或破裂者，阴道后穹隆饱满，有触痛），最可能的诊断是输卵管妊娠（A对）。肠结核（八版内科学P379）（B错）的常见临床表现为腹痛、腹泻、便秘及低热、乏力、盗汗等全身症状，可触及腹部包块。急性输卵管炎（P261）（C错）的常见临床表现为下腹部两侧剧烈疼痛，阴道分泌物增多，有时伴有尿频、尿痛等症状。急性肠炎（D错）的主要症状为恶心、呕吐、腹痛、腹泻、发热。胃溃疡穿孔（八版外科学P355）（E错）突发上腹部剧痛，呈刀割样，腹痛迅速波及全腹，常伴恶心呕吐，面色苍白，血压下降。